医学伦理难题产生的现实原因除外
A. 权利与义务的冲突
B. 个人价值追求的多元化
C. 医学高新技术应用带来的伦理挑战
D. 卫生法律法规不够健全
E. 医疗机构管理规范

正确答案：E。医疗机构管理规范

解析：本题考查临床治疗的伦理决策。医学伦理难题产生的现实原因包括权利与义务的冲突（A对），个人价值追求的多元化（B对），医学高新技术应用带来的伦理挑战（C对），卫生法律法规不够健全（D对），医疗机构管理欠规范。不是医疗机构管理规范（E错，为本题正确答案）。